男，50岁。高热伴进行性呼吸困难4天。既往体健。查体：T39.4℃，R32次/分，双肺呼吸音清，未闻及干湿性啰音。胸部CT示双肺弥漫分布的磨玻璃影，血WBC8.5×10⁹/L，CRP24mg/L。SaO₂88%。患者最可能感染的病原体是
A. 结核分枝杆菌
B. 军团菌
C. 肺孢子菌
D. 病毒
E. 肺炎支原体

正确答案：D。病毒

解析：中年患者，高热伴进行性呼吸困难，查体：T39.4℃（正常值为36℃～37℃，提示发热），R32次/分（正常值为12～20次，提示呼吸增快），双肺呼吸音清，未闻及干湿性啰音，血WBC8.5×10⁹/L（正常值为4～10×10⁹/L），CRP24mg/L（正常值<2.87mg/L），SaO₂88%（正常值为95%-98%，提示缺氧），胸部CT示双肺弥漫分布的磨玻璃影（病毒性肺炎的典型影像学表现），根据患者的临床症状及体征，考虑最可能感染的病原体是病毒（D对），病毒感染者症状较轻，常无显著的胸部特征，病情严重者呼吸浅快、心率增快发绀、肺部干湿性啰音，白细胞一般不增高，CT常表现为沿小叶分布的磨玻璃影。结核分支杆菌（A错）感染者多表现为咳嗽、咳痰及午后潮热；肺孢子菌（C错）多继发于艾滋病及恶性肿瘤患者，CT表现为弥漫点状或磨玻璃影，主要表现为发热、干咳及进行性呼吸困难；军团菌感染（B错）者CT示下叶斑片浸润，进展迅速，无空洞；肺炎支原体感染（E错）CT示肺部多种形态的浸润影，呈节段性分布，以肺下野为多见，有的从肺门附近向外伸展。